白矾既可外用又可内服，其主治病证不包括
A. 痰热癫狂
B. 痰热喘哮
C. 吐衄下血
D. 湿热黄疸
E. 湿疹瘙痒

正确答案：B。痰热喘哮

解析：本题考查的是白矾的主治病证。白矾既可外用又可内服，其主治病证不包括痰热喘哮（B错，为本题正确答案）。白矾：【主治病证】（1）疮疡，疥癣，湿疹瘙痒（E对），阴痒带下。（2）吐衄下血（C对），泻痢不止。（3）风痰痫病，痰热癫狂（A对）。（4）湿热黄疸（D对）。